产生IL-2的细胞是
A. 巨噬细胞
B. 肥大细胞
C. T淋巴细胞
D. B细胞
E. 嗜酸性粒细胞

正确答案：C。T淋巴细胞

解析：本题考查产生IL-2的细胞。产生IL-2的细胞是T淋巴细胞（C对）。巨噬细胞（A错）是单核细胞从血液移行到全身组织器官，其主要生物学功能为杀伤清除病原体，杀伤胞内寄生菌和肿瘤等靶细胞，参与炎症反应，加工提呈抗原启动适应性免疫应答，免疫调节作用等。肥大细胞（B错）主要分布于呼吸道、胃肠道和泌尿生殖道的黏膜上皮及皮肤下的结缔组织内靠近血管处，参与I型超敏反应。B细胞（D错）由哺乳动物骨髓或禽类法氏囊中的淋巴样干细胞分化发育而来；成熟B细胞主要定居于外周淋巴器官的淋巴滤泡内，约占外周淋巴细胞总数的20%；B细胞表面的多种膜分子在其分化和功能执行中有重要作用；B细胞不仅能通过产生抗体发挥特异性体液免疫功能，同时也是重要的抗原提呈细胞，并参与免疫调节。嗜酸性粒细胞（E对）主要分布于呼吸道、消化道和泌尿生殖道黏膜上皮下的结缔组织内，循环血中仅有少量存在,嗜酸性粒细胞还能释放组胺酶和芳基硫酸酯酶，灭活肥大细胞释放的组胺和LT，对I型超敏反应起到一定的抑制作用